急性坏死性龈炎应采用下列方法治疗，除了
A. 去除局部坏死组织并刮除大块牙石
B. 局部使用1%～3%双氧水冲洗
C. 常规全身应用青霉素
D. 支持疗法，并对全身因素进行矫治
E. 口腔卫生指导，建立良好的口腔卫生习惯

正确答案：C。常规全身应用青霉素

解析：①去除局部坏死组织：急性期应首先轻轻去除牙龈乳头及龈缘的坏死组织，并初步去除大块的龈上牙石。②局部使用氧化剂：1%～3%过氧化氢溶液局部擦拭、冲洗和反复含漱，有助于去除残余的坏死组织。当过氧化氢遇到组织和坏死物中的过氧化氢酶时，能释放出大量的新生态氧，能杀灭或抑制厌氧菌。必要时，在清洁后的局部可涂布或贴敷抗厌氧菌的制剂。
③全身药物治疗：全身给予维生素C、蛋白质等支持疗法。重症患者可口服甲硝唑或替硝唑等抗厌氧菌药物2～3天，有助于疾病的控制。④及时进行口腔卫生指导：立即更换牙刷，保持口腔清洁，指导患者建立良好的口腔卫生习惯，以防复发。⑤对全身性因素进行矫正和治疗。⑥急性期过后的治疗：急性期过后，对原已存在的慢性牙龈炎或牙周炎应及时治疗，通过洁治和刮治术去除菌斑、牙石等一切局部刺激因素，对外形异常的牙龈组织，可通过牙龈成形术等进行矫正，以利于局部菌斑控制和防止复发。掌握“坏死性溃疡性龈炎”知识点。